半夏的后含物
A. 草酸钙方晶
B. 草酸钙砂晶
C. 草酸钙簇晶
D. 草酸钙针晶
E. 草酸钙柱晶

正确答案：D。草酸钙针晶

解析：本题考查的是半夏的后含物。半夏的后含物草酸钙针晶（D对）。半夏【显微鉴别】粉末：类白色。①淀粉粒极多，单粒类球形或圆多角形，直径2～20μm，脐点短缝状、人字状或星状；复粒由2～6分粒组成。②草酸钙针晶较多，散在或成束存在于椭圆形黏液细胞中，针晶长20～144μm。③导管为螺纹及环纹。关黄柏【显微鉴别】粉末：绿黄色或黄色。①纤维鲜黄色，直径16～38μm，常成束，周围的细胞含草酸钙方晶（A错），形成晶纤维；含晶细胞壁木化增厚。②石细胞众多，鲜黄色，类圆形或纺锤形，长径35～80μm，有的呈分枝状，壁厚，层纹明显。③草酸钙方晶极多，直径12～30μm。牛膝【显微鉴别】粉末：土黄色。①木纤维较长，壁微木化，胞腔大，具斜形单纹孔。②导管网纹、单纹孔或具缘纹孔。③薄壁细胞含草酸钙砂晶（B错）。④木薄壁细胞长方形，有的具单纹孔或网纹增厚。⑤木栓细胞类长方形，淡黄色。大黄【显微鉴别】粉末：黄棕色。①草酸钙簇晶（C错）大而多，直径20～160μm，有的至190μm。②导管多为网纹，并有具缘纹孔、螺纹及环纹导管，直径11～140μm，非木化。③淀粉粒甚多，单粒呈类球形或多角形，直径3～45μm，脐点星状，复粒由2～8分粒组成。沉香【显微鉴别】粉末：黑棕色。①纤维管胞长梭形，多成束，直径20～30μm，壁较薄，有具缘纹孔。②韧型纤维较少见，直径25～45μm，径向壁上有单斜纹孔。③具缘纹孔导管多见，直径约至130μm，具缘纹孔排列紧密，互列，导管内棕色树脂团块常破碎脱出。④木射线细胞单纹孔较密。⑤内涵韧皮部薄壁细胞含黄棕色物质，细胞壁非木化，有时可见纵斜交错纹理及菌丝。⑥草酸钙柱晶（E错），长68μm，直径9～15μm。